妇康片的功能是
A. 暖宫调经
B. 补虚止带，和血调经
C. 解郁调经
D. 舒肝清热，健脾养血
E. 补气，养血，调经

正确答案：E。补气，养血，调经